桑螵蛸的药用部位是
A. 干燥卵鞘
B. 干燥胆结石
C. 干燥内壳
D. 雌虫干燥体
E. 雄虫干燥体

正确答案：A。干燥卵鞘

解析：本题考查的是桑螵蛸的来源。桑螵蛸的药用部位是干燥卵鞘（A对）。桑螵蛸：【来源】为节肢动物门昆虫纲螳螂科昆虫大刀螂、小刀螂或巨斧螳螂的干燥卵鞘。以上三种分别习称“团螵蛸”“长螵蛸”及“黑螵蛸”。药用部位是干燥胆结石（B错）的中药是牛黄。牛黄：【来源】为脊索动物门哺乳纲牛科动物牛干燥的胆结石。习称“天然牛黄”。在胆囊中产生的称“胆黄”或“蛋黄”，在胆管中产生的称“管黄”，在肝管中产生的称“肝黄”。药用部位为干燥内壳（C错）的中药是海螵蛸。海螵蛸：【来源】为软体动物门乌贼科动物无针乌贼或金乌贼的干燥内壳。药用部位是雌虫干燥体（D错）的中药是土鳖虫。土鳖虫：【来源】为节肢动物门昆虫纲鳖蠊科昆虫地鳖或冀地鳖的雌虫干燥体。以雄虫干燥体入药（E错）的中药，2022年考试指南未明确说明。